关于维拉帕米，哪项错误
A. 是治疗阵发性室上性心动过速的首选药
B. 对肥厚型心肌病无效
C. 能改善心室的舒张功能
D. 禁用于严重心衰的病人
E. 能增加缺血心肌的冠脉流量

正确答案：B。对肥厚型心肌病无效